可用维生素B₆防治的异烟肼的不良反应是
A. 肝损伤
B. 过敏反应
C. 周围神经炎
D. 胃肠道反应
E. 粒细胞减少

正确答案：C。周围神经炎

解析：本题考查异烟肼的不良反应。可用维生素B₆防治的异烟肼的不良反应是周围神经炎（C对）。异烟肼为维生素B₆的拮抗剂，可增加维生素B₆经肾排出量，易致周围神经炎的发生。同时服用维生素B₆者，需酌情增加用量。